治疗喘证痰热郁肺证，应首选
A. 桑白皮汤
B. 麻杏石甘汤
C. 苏子降气汤
D. 定喘汤
E. 泻白散

正确答案：A。桑白皮汤

解析：喘证痰热郁肺证是由于邪热蕴肺，蒸液成痰，痰热壅滞，肺失清肃，治疗时要清热化痰，宣肺平喘，清热宣肺化痰的桑白皮汤最为合适（A对）。麻杏石甘汤功能宣肺泄热，降气平喘，为喘证表寒肺热证的选方（B错）。苏子降气汤功能降气平喘，祛痰止咳，主治上实下虚喘咳证（C错）。定喘汤功能清热宣肺，化痰平喘，为治疗哮病发作期之热哮证的选方（D错）。泻白散功能顺气降火，清肺化痰，常合黛蛤散治疗咳嗽肝火犯肺证（E错）。